正常成年人体液总量约占体重的
A. 0.3
B. 0.4
C. 0.5
D. 0.6
E. 0.7

正确答案：D。0.6